磷酸戊糖途径的生理意义是生成
A. 5-磷酸核糖和NADH⁺H⁺
B. 6-磷酸果糖和NADPH⁺H⁺
C. 3-磷酸甘油醛和NADH⁺H⁺
D. 5-磷酸核糖和NADPH⁺H⁺
E. 6-磷酸葡萄糖酸和NADH⁺H⁺

正确答案：D。5-磷酸核糖和NADPH⁺H⁺